患者女65岁，近日突发呼吸困难，肺部充满湿啰音，咳粉红色泡沫痰，既往冠心病史10年，R35次/分，BP80/50mmHg，心率102次/分，S3奔马律。若该患者病情控制后，为进一步明确发病原因，应该首先选择下列哪项检查
A. 冠状动脉造影
B. 动态心电图
C. 动态心电图平板实验
D. 超声心动图
E. CT肺动脉造影

正确答案：A。冠状动脉造影

解析：患者突发呼吸困难，咳粉红色泡沫痰（急性左心衰竭的特征性表现），R35次/分，BP80/50mmHg，肺部充满湿啰音，心率102次/分，S3奔马律，诊断宜首先考虑急性左心衰竭。患者既往多年冠心病史，需明确此次急性左心衰是否冠心病所致。冠状动脉造影（A对）是诊断冠心病的金标准。动态心电图（B错）可连续记录24~72 小时心电信号，可以提高对非持续性心律失常及短暂心肌缺血发作的检出率。动态心电图平板实验（C错）通过运动增加心脏负荷而诱发心肌缺血，从而出现缺血性心电图改变的试验方法，可用来辅助诊断冠心病，但不是金标准。超声心动图（D错）是诊断心脏瓣膜病的金标准。CT肺动脉造影（E错）是诊断肺栓塞的金标准。